人类建（牙合）过程是从
A. 恒切牙萌出时开始直到第三磨牙萌出才完成
B. 乳牙萌出时开始直到第二磨牙萌出才完成
C. 乳牙萌出时开始直到第二乳牙萌出才完成
D. 恒牙萌出时开始直到18岁才完成
E. 乳牙萌出时开始直到18岁才完成

正确答案：B。乳牙萌出时开始直到第二磨牙萌出才完成

解析：本题考查人类建（牙合）的过程。人类建（牙合）分为建立乳牙（牙合）与恒牙（牙合）两个过程，完整的建（牙合）过程从乳牙萌出（AD错）开始，直到12岁第二磨牙萌出（B对E错）建立咬合关系为止。乳牙（牙合）的建立是指从乳牙萌出开始直到第二乳磨牙萌出为止（C错）。